重度主动脉瓣狭窄的跨主动脉瓣平均压力阶差至少应大于
A. 35mmHg
B. 40mmHg
C. 45mmHg
D. 50mmHg
E. 55mmHg

正确答案：B。40mmHg

解析：九版内科学教材P296认为主动脉瓣重度狭窄时射流速度＞4m/s，平均压力阶差＞40mmHg（B对），瓣口面积＜1.0cm²。七版内科学教材P315认为主动脉瓣重度狭窄时平均压差＞50mmHg或峰压差达70mmHg。此题为老题，七、九版内科学数据有所不同，现在应以第九版教材为准。